极毒性药品是
A. 松节油
B. 氯化钡
C. 氢氧化钠
D. 甘露醇
E. 乳酶生

正确答案：B。氯化钡

解析：本题考查极毒性药品。氯化钡（B对）是极毒性药品，食入0.2～0.5g可引起中毒，致死剂量为0.8～0.9g，如发现中毒，速服硫酸镁或硫酸钠，采取洗胃、灌肠、催吐等措施，迅速就医。松节油（A错）为易燃液体。氢氧化钠（C错）是有腐蚀性的药品。